职业肿瘤的发病特点，不包括
A. 接触明确的致癌因素
B. 潜伏期长、但发病年龄早
C. 有一定好发部位
D. 同一致癌物可引起不同部位肿瘤
E. 潜伏期长、发病年龄以50～60岁多见

正确答案：E。潜伏期长、发病年龄以50～60岁多见

解析：本题考查职业肿瘤的发病特点。不同的致癌因素引起的职业性肿瘤有不同的潜隐期和潜伏期，有的疾病潜伏期仅仅有几个月，有的疾病潜伏期可达几十年。尽管如此，由于职业性致癌因素接触强度一般都较高，所以职业性肿瘤的发病年龄比非职业性同类肿瘤提前（E错，为本题正确答案），职业性肿瘤发病年龄较早（B对）；职业性肿瘤有比较固定的好发部位（C对）或范围，多在致癌因素作用最强烈、最经常接触的部位发生；同一致癌物也可能引起不同部位的肿瘤（D对）；职业性肿瘤的特征之一是病因明确，都有明确的致癌因素接触史（A对），但人体接触职业性致癌因素后不一定都发生职业性肿瘤。